可由于血浆蛋白结合置换作用而易引起危险的联合用药是
A. 阿莫西林+克拉维酸钾
B. 磺胺甲噁唑+甲氧苄啶
C. 阿司匹林+甲苯磺丁脲
D. 硫酸亚铁+维生素C
E. 氢溴酸山莨菪碱+盐酸哌替啶

正确答案：C。阿司匹林+甲苯磺丁脲

解析：本题考查药物的联合应用。阿司匹林+甲苯磺丁脲（C对）联合应用可由于血浆蛋白结合置换作用而易引起危险。阿莫西林与克拉维酸钾合用时后者可保护前者免受酶破坏，提高疗效（A错）。磺胺甲噁唑与甲氧苄啶合用对细菌合成叶酸有双重阻断作用（B错）。硫酸亚铁合用维生素C可以促进人体对铁剂的吸收（D错）。氢溴酸山莨菪碱与盐酸哌替啶合用（E错）时可增加毒性。